前列腺炎的主要临床表现是
A. 无痛性血尿
B. 精液中有血
C. 尿中有血，并有腰部剧痛
D. 尿频、进行性排尿困难
E. 尿频急而痛，尿末常有白色分泌物

正确答案：E。尿频急而痛，尿末常有白色分泌物

解析：前列腺炎无血尿（A错）。前列腺炎精液多无血（B错）。前列腺炎尿中无血，并且腰部为隐痛（C错）。前列腺炎无进行下排尿困难，仅有排尿不适感（D错）。前列腺炎主要表现为轻微尿频、尿急、尿痛，在排尿终末或大便用力时，可自尿道滴出少量白色前列腺液（E对）。